至今临床上主要采用的牙种植体是
A. 骨膜下种植体
B. 骨内种植体
C. 牙内骨内种植体
D. 黏膜内种植体
E. 穿下颌种植体

正确答案：B。骨内种植体

解析：目前种植体还没有一个统一的分类标准，但通常人们按植入部位及种植体形状进行分类。按植入部位区分的有：骨内种植体、骨膜下种植体、牙内骨内种植体、黏膜内种植体以及穿下颌种植体和下颌支支架种植体等。至今临床主要应用的是用骨内种植体，外形多为柱状或螺旋柱状及根形锥状，表面均进行了粗化处理。掌握“牙种植术概论”知识点。